淤血不会引起
A. 水肿
B. 血栓形成
C. 变性、坏死
D. 纤维组织增生
E. 实质细胞增生

正确答案：E。实质细胞增生

解析：淤血时，缺氧和血管内流体静压升高导致血管通透性增加，水、盐和蛋白质漏出并潴留在组织内形成水肿（A对）；淤血可导致血流减慢，有利于血栓形成（B对）；淤血时间过长时，组织缺氧、营养物质供应不足和代谢中间产物堆积，可导致实质细胞变性坏死（C对）而不是增生（E错，为本题正确答案），以及间质纤维组织增生（D对）。